延伸卡环除固位外，还具有
A. 夹板固定作用
B. 防止食物嵌塞作用
C. 保护孤立牙作用
D. 减轻（牙合）力作用
E. 都不是

正确答案：A。夹板固定作用

解析：延伸卡环：用于松动或牙冠外形差的基牙，将卡环臂延伸到邻近牙齿的倒凹区以获得固位和夹板固定作用。掌握“局部义齿固位体”知识点。